某研究者检测了100例45～50岁女性的血清雌二醇（pg/ml）和腰椎骨密度BMD（g/cm²）含量，欲了解两个指标之间是否存在数量依存关系，拟通过血清雌二醇水平预测腰椎BMD，宜先绘制
A. 直条图
B. 圆图
C. 普通线图
D. 直方图
E. 散点图

正确答案：E。散点图